我国现存最早的医学专著是
A. 《五十二病方》
B. 《神农本草经》
C. 《黄帝内经》
D. 《中藏经》
E. 《伤寒论》

正确答案：C。《黄帝内经》

解析：中医学理论体系形成的标志是《黄帝内经》《难经》《伤寒杂病论》《神农本草经》等四部医学经典著作的问世。《黄帝内经》约成书于战国至秦汉时期（C对）。在现存医书中，最早记载方剂的是1973年长沙马王堆汉墓中出土的《五十二病方》（A错）。《神农本草经》简称《本草经》或《本经》，成书于东汉，为现存最早的中药学专著（B错）。《中藏经》禀承了《内经》天人相应、顺应自然，以阴阳为总纲的思想，发展了阴阳学说，倡导重阳论（D错）。《伤寒杂病论》张机（字仲景）所著，成书于东汉，为中医第一部辨证论治的专著（E错）。